关于妊娠滋养细胞肿瘤的发生，正确的是
A. 侵蚀性葡萄胎可继发于流产后
B. 侵蚀性葡萄胎不会发生子宫外转移
C. 侵蚀性葡萄胎多继发于葡萄胎清宫后1年以上
D. 绝经后妇女不会发生绒毛膜癌
E. 绒毛膜癌可继发于足月妊娠或异位妊娠后

正确答案：E。绒毛膜癌可继发于足月妊娠或异位妊娠后

解析：侵蚀性葡萄胎全部继发于葡萄胎妊娠（A错），多继发于葡萄胎清宫半年内（C错），但恶性程度一般不高，大多数仅造成局部侵犯，有4%的患者并发子宫外转移（B错）。绒癌多继发于葡萄胎清宫后1年以上，也可继发于足月妊娠或异位妊娠后（E对），绝经后妇女也可发生绒毛膜癌（D错）。